下列被称为“元神之府”的是自
A. 脑
B. 髓
C. 骨
D. 脉
E. 胆

正确答案：A。脑

解析：脑（A对）为元神之府。《素问·五藏生成》说：“诸髓（B错）者，皆属于脑；脉（D错）为血之府”；《素问·灵兰秘典论》说“胆（E错）者，中正之官，决断出焉。”